诊断为龋齿时，在正常牙面温度测验的结果是
A. 正常
B. 一过性敏感
C. 敏感
D. 迟钝
E. 无反应

正确答案：A。正常

解析：本题考查牙髓温度测验。龋齿的牙髓活力一般正常，在正常牙面温度测验反应和正常牙相同即反应正常（A对），温度测验龋齿只有温度刺激进入患牙龋洞时才会出现一过性敏感。可复性牙髓炎温度测验表现为一过性敏感（B错）。急性牙髓炎温度测验时表现为敏感（C错）。慢性牙髓炎、牙髓变性或牙髓部分坏死时温度测验表现为牙髓反应迟钝（D错）。牙髓坏死或牙髓变性时温度刺激不产生反应（E错）。